为描述新冠肺炎病毒患者工作构成比的资料，宜选用
A. 直条图
B. 散点图
C. 圆图
D. 直方图
E. 线图

正确答案：C。圆图

解析：圆图（C对）常用于描述构成比资料，把圆的总面积作为100%来表示事物的全部，以圆内各扇形面积表示各部分所占的比例。直条图（A错）是描述定性数据的统计图，用等宽直条的长短表示相互独立的统计指标数值大小。散点图（B错）是通过点的密集程度和变化趋势表示两指标之间的直线或曲线关系。直方图（D错）主要用于表示连续变量频数分布情况。线图（E错）是通过线段的升降来表示指标的连续变化情况，适用于描述一个变量随另一个变量变化的趋势。